常使用药物溶液，注射剂量可以超过5ml的给药途径有
A. 静脉注射
B. 脊椎腔注射
C. 肌内注射
D. 皮下注射
E. 皮内注射

正确答案：A、B。静脉注射；脊椎腔注射

解析：本题考查不同给药途径注射剂的注射量。注射剂的给药途径有静脉注射、脊椎腔注射、肌内注射、皮下注射和皮内注射。静脉注射（A对）：分为静脉推注和静脉滴注，前者一般5～50ml，后者一般不小于100ml。脊椎腔（B对）注射量不超过10ml。肌内注射一次剂量一般在1～5ml。皮下注射通常为1～2ml。皮内注射一次注射量在0.2ml以下。